长期从事聚氯乙烯生产的清釜工，近来感到手指麻木和疼痛，并发白，最可能的诊断是
A. 肩关节病
B. 颈肩腕综合征
C. 周围神经炎
D. 末梢神经炎
E. 肢端溶骨症

正确答案：E。肢端溶骨症

解析：本题考查肢端溶骨症的症状。肢端溶骨症（E对ABCD错）多发生于工龄较长的清釜工。早期表现为雷诺综合征：手指麻木、疼痛、肿胀、变白或发绀等。随后逐渐出现末节指骨骨质溶解性损害。X线常见一指或多指末节指骨粗隆边缘呈半月状缺损，伴有骨皮质硬化，最后发展至指骨变粗变短，外形似鼓槌（杵状指）。目前认为，肢端溶骨征是氯乙烯所致全身性改变在指端局部的一种表现。